重度高钾血症时，心肌的
A. 兴奋性↑传导性↑自律性↑
B. 兴奋性↑传导性↑自律性↓
C. 兴奋性↑传导性↓自律性↑
D. 兴奋性↓传导性↓自律性↓
E. 兴奋性↓传导性↑自律性↑

正确答案：D。兴奋性↓传导性↓自律性↓

解析：轻度高钾血症时，细胞兴奋性增高（ABC错）。重度高钾血症时 表现为细胞兴奋性降低，细胞膜对于钾离子的通透性增高，复极化4期，钾离子外流增加，而钠离子内流相对缓慢，快反应自律细胞的自动去极化减慢，因而引起心肌自律性降低（E错），由于心肌细胞静息电位绝对值变小与阈电位接近，0期钠通道不容易开放，使去极化的速度减慢，幅度变小，因此心肌兴奋传导的速度也会减慢（D对）。